儿童多发性抽动症阴虚风动证首选方剂是
A. 《千金》龙胆汤加减
B. 礞石滚痰丸加减
C. 醒脾散加减
D. 知柏地黄汤
E. 大定风珠加减

正确答案：E。大定风珠加减

解析：因素体肾阴不足，或久病及肾，肾阴亏虚，水不涵木，可致筋脉失养而出现虚风内动。相火妄动，夹痰上扰，闭阻咽喉，金鸣异常，则喉发异声。本证以肢体震颤，咽干清嗓，五心烦热，性情急躁为临床特征，所以宜用具有滋阴潜阳，柔肝息风的大定风珠（E对）；《千金》龙胆汤具有清热舒利的功效，用于治疗婴儿发热，呕吐下利，舌上生疮，毛发不泽，脐风，惊痫（A错）；礞石滚痰丸具有降火逐痰之功效，用于治疗痰火扰心所致的癫狂惊悸，或喘咳痰稠、大便秘结（B错）；醒脾散具有调理脾胃，用于治疗婴孩、小儿吐泻不止，脾困昏沉，默默不食（C错）；知柏地黄汤具有养阴清热，疏通尿道之功效。主治阴虚火盛，下焦湿热等证。症见面色潮红，两额发赤，精神空虚，食欲不佳，呼吸气促，语音细弱，夜间发热，盗汗失眠，耳鸣腰痛，头晕眼花，大便秘结。自从产后不久，忽然小便闭塞不通，小腹中胀满疼痛。唇色焦红，舌绛无苔，脉沉细数（D错）。